属于单胺氧化酶抑制剂的抗抑郁药是
A. 盐酸阿米替林
B. 吗氯贝胺
C. 盐酸氟西汀
D. 盐酸帕西汀
E. 舍曲林

正确答案：B。吗氯贝胺

解析：本题考查单胺氧化酶抑制剂。属于单胺氧化酶抑制剂的抗抑郁药是吗氯贝胺（B对）。吗氯贝胺为单胺氧化酶抑制剂，通过抑制A型单胺氧化酶，减少去甲肾上腺素、5-HT及多巴胺的降解，增强去甲肾上腺素、5-HT和多巴胺能神经功能而发挥抗抑郁作用。盐酸阿米替林（A错）为三环类抗抑郁药。盐酸氟西汀（C错）、盐酸帕西汀（D错）、舍曲林（E错）均为5-羟色胺再摄取抑制剂（SSRI）。